具有保护性的抗体是
A. 抗-HBe
B. 抗-HBc
C. 抗-HBs
D. 抗-HBc IgG
E. 抗-HBc IgM

正确答案：C。抗-HBs

解析：本题考查具有保护性的抗体。乙型肝炎表面抗体，是机体受HBsAg刺激而产生的相应抗体，它可以与HBsAg相结合，在体内其他免疫系统共同作用下清除病毒，以保护机体不再受HBV的感染。所以抗-HBs（C对ABDE错）是具有特异性保护功能的中和抗体，有抗-HBs，表明机体已产生免疫力。